治疗风湿热肝肾两虚证，应首选
A. 八珍汤
B. 归脾汤
C. 虎潜丸
D. 独活寄生汤
E. 三痹汤

正确答案：D。独活寄生汤

解析：独活寄生汤加减（D对）可以益肝肾，补气血，祛风湿，通经络，用于治疗风湿热肝肾两虚证。八珍汤（A错）可益气养血，治疗蝶疮流注的气血两虚证。归脾汤（B错）可健脾养心，补益气血，治疗心脾气血两虚证。虎潜丸（C错）可以滋阴降火，强壮筋骨，治疗肝肾不足，阴虚内热之痿证。三痹汤（E错）可益气养血，袪风胜湿，治疗肝肾亏虚，气血不足之痹证。